对于慢性化脓性唾液腺炎的临床表现描述正确的是
A. 常见为双侧、对称发病
B. 唾液腺弥漫性肿大，酸胀感明显
C. 进食时减轻
D. 挤压患侧唾液腺，导管口流出黏稠而有甜味的液体
E. 造影表现为主导管腊肠状改变，末梢导管点状扩张

正确答案：E。造影表现为主导管腊肠状改变，末梢导管点状扩张

解析：慢性化脓性唾液腺炎常为单侧发病，唾液腺局部肿大，酸胀感，进食时加重。挤压患侧唾液腺，导管口流出少量黏稠而有咸味的液体。唾液腺造影表现为主导管呈腊肠状，末梢导管呈点球状扩张。掌握“慢性唾液腺炎的病理变化”知识点。